用煮沸灭菌法灭菌后的物品，其有效期为
A. 4小时
B. 8小时
C. 10小时
D. 12小时
E. 24小时

正确答案：A。4小时

解析：用煮沸灭菌法灭菌后的物品，其有效期为4小时（A对）。